下列哪种情况容易导致重金属向农作物中转移
A. 土壤中富含大量的腐殖质
B. 土壤的pH较高，呈碱性
C. 土壤处于还原状态
D. 土壤的pH较低，呈酸性
E. 土壤中富含无机矿物质胶体

正确答案：D。土壤的pH较低，呈酸性

解析：本题考查重金属向农作物的转移。重金属向农作物中转移的主要原因是土壤pH值的变化，土壤pH值越低，重金属的溶解度就越高，重金属就越容易被植物吸收。因此，土壤的pH较低，呈酸性（D对ABCE错）是容易导致重金属向农作物中转移的情况。